患者16岁，男性，1小时前上前牙外伤，查：左上1唇向错位，松动Ⅱ度，叩（±），牙龈轻度红肿，右上1左上2叩（-）、松（-）、牙髓活力测同对照牙，X线未见根折，该患者处理为
A. 自行愈合
B. 调（牙合）观察
C. 复位固定，观察
D. 牙髓治疗后复位固定
E. 拔除

正确答案：C。复位固定，观察

解析：本题考查牙脱位的治疗。患者16岁，男性，1小时前上前牙外伤，查：左上1唇向错位，松动Ⅱ度，叩（±），牙龈轻度红肿，右上1左上2叩（-）、松（-）、牙髓活力测同对照牙，X线未见根折，该患者处理为复位固定，观察（C对）。患者上前牙外伤后，左上1唇向错位，松动Ⅱ度，叩（±），牙龈轻度红肿，X线未见根折，可知左上1为部分牙脱位。部分牙脱位应在局麻下将复位固定，观察，并定期复诊。对于嵌入性脱位的年轻恒牙，应任其自然萌出，不可强行拉出复位，以免造成更大的创伤（A错）。患牙复位后，若有咬合障碍，应进行调（牙合）处理，患牙为左上中切牙唇侧脱位，复位后一般不会出现咬合障碍，不需调（牙合）处理（B错）。牙完全脱位2小时以后再就诊者，牙髓和牙周膜已经坏死，应在体外进行根管治疗后，再将患牙植入固定（D错）。无保留价值的患牙应予以拔除，该患牙唇向脱位，进行复位固定，待其恢复后可正常使用，不应拔除（E错）。